某女，42岁。患月经不调、带下病，症见月经先后不定期，量多或淋沥不净、色淡无块，带下量多、色白清稀，神疲乏力，腰膝酸软。证属脾肾两虚。治当健脾补肾，调经止带，宜选用的成药是
A. 桂枝茯苓丸
B. 妇科千金片
C. 千金止带丸
D. 益母草胶囊
E. 妇炎平胶囊

正确答案：C。千金止带丸

解析：本题考查的是千金止带丸的功能。患月经不调、带下病，症见月经先后不定期，量多或淋沥不净、色淡无块，带下量多、色白清稀，神疲乏力，腰膝酸软。证属脾肾两虚。治当健脾补肾，调经止带，宜选用的成药是千金止带丸（C对）。千金止带丸：【功能】健脾补肾，调经止带。桂枝茯苓丸（A错）：【功能】活血，化瘀，消癥。妇科千金片（B错）：【功能】清热除湿，益气化瘀。益母草胶囊（D错）：【功能】活血调经。妇炎平胶囊（E错）：【功能】清热解毒，燥湿止带，杀虫止痒。